厚朴的性状鉴别特征是
A. 内表面红棕色，划之显油痕，断面中间有1条黄棕色线纹，气香浓烈，味甜辣
B. 内表面淡灰黄色或浅棕色，常见发亮的结晶，断面较平坦，气芳香，味微苦而涩
C. 内表面暗紫色或紫褐色，断面有细密、银白色富弹性的橡胶丝相连，气微味稍苦
D. 内表面黄色或黄棕色，断面纤维性，有的呈裂片状分层，气微、味极苦，嚼之有黏性
E. 内表面紫棕色或深紫褐色划之显油痕，断面有的可见多数小亮星，气香，味辛辣、微苦

正确答案：E。内表面紫棕色或深紫褐色划之显油痕，断面有的可见多数小亮星，气香，味辛辣、微苦

解析：本题考查的是厚朴药材的性状鉴别。厚朴的性状鉴别特征是内表面紫棕色或深紫褐色划之显油痕，断面有的可见多数小亮星，气香，味辛辣、微苦（E对）。厚朴：【性状鉴别】药材干皮呈卷筒状或双卷筒状，习称“筒朴”；近根部干皮一端展开如喇叭口，习称“靴筒朴”。外表面灰棕色或灰褐色，粗糙，有时呈鳞片状，较易剥落，有明显的椭圆形皮孔和纵皱纹；刮去粗皮者显黄棕色。内表面紫棕色或深紫褐色，较平滑，具细密纵纹，划之显油痕。质坚硬，不易折断，断面颗粒性，外层灰棕色，内层紫褐色或棕色，有油性，有的可见多数小亮星。气香，味辛辣、味苦。内表面红棕色，划之显油痕，断面中间有1条黄棕色线纹，气香浓烈，味甜辣（A错）为肉桂药材的鉴别特征。肉桂：【性状鉴别】药材饮片呈槽状或卷筒状。外表面灰棕色，稍粗糙，有不规则的细皱纹及横向突起的皮孔，有的可见灰白色的斑纹；内表面红棕色，较平坦，有细纵纹，划之显油痕。质硬而脆，易折断，断面不平坦，外层棕色而较粗糙，内层红棕色而油润，两层中间有1条黄棕色的线纹。气香浓烈，味甜、辣。内表面淡灰黄色或浅棕色，常见发亮的结晶，断面较平坦，气芳香，味微苦而涩（B错）为牡丹皮药材的鉴别特征。牡丹皮：【性状鉴别】药材连丹皮（原丹皮）呈筒状或半筒状，有纵剖开的裂缝，略向内卷曲或张开。外表面灰褐色或黄褐色，有多数横长皮孔样突起及细根痕，栓皮脱落处粉红色；内表面淡灰黄色或浅棕色，有明显的细纵纹，常见发亮的结晶。质硬而脆，易折断，断面较平坦，淡粉红色，粉性。气芳香，味微苦而涩。内表面暗紫色或紫褐色，断面有细密、银白色富弹性的橡胶丝相连，气微味稍苦（C错）为杜仲药材的鉴别特征。杜仲：【性状鉴别】药材呈板片状或两边稍向内卷，大小不一。外表面淡灰棕色或灰褐色，有明显的皱纹或纵裂槽纹，有的树皮较薄，未去粗皮，可见明显的斜方形皮孔，内表面暗紫色或紫褐色，光滑。质脆，易折断。断面有细密、银白色、富弹性的橡胶丝相连。气微，味稍苦。内表面黄色或黄棕色，断面纤维性，有的呈裂片状分层，气微、味极苦，嚼之有黏性（D错）为黄柏药材的鉴别特征。黄柏：【性状鉴别】药材呈板片状或浅槽状，长宽不一。外表面黄棕色或黄褐色，平坦或具纵沟纹，有的可见皮孔痕及残存的灰褐色粗皮；内表面暗黄色或淡棕色，具细密的纵棱纹。体轻，质较硬，断面纤维性，呈裂片状分层，深黄色。气微，味极苦，嚼之有黏性。